男孩，2岁。1岁时患麻疹后食欲差，常有腹泻，身高83cm，体重7600g，面色苍白，皮肤干燥，腹部皮下脂肪0.3cm，心音低钝，脉搏缓慢。假设该患儿出现哭而少泪，眼球结膜有毕脱斑，则并发有
A. 维生素A缺乏
B. 维生素B缺乏
C. 维生素C缺乏
D. 维生素D缺乏
E. 维生素E缺乏

正确答案：A。维生素A缺乏

解析：结膜干燥斑或毕脱斑见于维生素A缺乏症，眼部检查可见结膜近处干燥起皱褶，角化上皮堆积成泡沫状白斑（A对）。